因肾上腺皮质激素的分泌具有晨高晚低的特点，故使用维持剂量的肾上腺皮质激素类药物时，推荐的服药时间是
A. 中午
B. 清晨
C. 上午
D. 下午
E. 临睡前

正确答案：B。清晨

解析：本题考查糖皮质激素使用时间。肾上腺糖皮质激素分泌高峰出现在清晨，血药浓度在上午8时左右最高，而后逐渐下降，直至夜间零点左右达最低，故其使用时间为清晨（B对）；餐前服用药物如胃黏膜保护药可以充分地黏附于胃壁，形成一层保护屏障；餐中服用的药物如降糖药等可减少对胃肠道的刺激；餐后服用的药物如胃溃疡药物，可利用餐后胃排空延迟来延长药物的作用时间；催眠药和服用后易出现嗜睡反应的药可以在睡前服用。